一患者上颌余右上67，下颌余左下67右下1，为了在模型上建立正确的（牙合）关系，应采用哪种方法
A. 用咬蜡的方法记录余留牙的咬合关系
B. 用蜡堤记录垂直距离
C. 用蜡堤记录正中关系
D. 用蜡堤记录垂直距离与正中关系
E. 直接用模型咬合确定垂直距离和正中关系

正确答案：D。用蜡堤记录垂直距离与正中关系

解析：本题考查可摘局部义齿确定颌位关系。确定正中咬合关系的方法有：模型上利用余留牙、利用蜡（牙合）记录、利用（牙合）堤记录确定上下牙的咬合关系。患者上下颌均为单侧游离缺失，每侧缺失2个牙以上，模型上不能准确确定颌关系，所以必须在口内确定颌位关系记录。因此应选择用蜡堤记录上下颌牙齿的咬合关系（D对）。上下颌牙齿的颌位关系包括垂直距离与正中关系，不应只记录垂直关系（B错）或正中关系（C错）。用咬蜡的方法记录余留牙的咬合关系（A错）适用于口内仍有可以保持上下颌垂直关系的后牙。直接用模型咬合确定垂直距离和正中关系（E错）适用于缺牙不多，余留牙的上下颌关系正常者。